用于一氧化碳中毒诊断
A. 血清碱性磷酸酶活性测定
B. 血中高铁血红蛋白含量测定
C. 全血胆碱脂酶活性测定
D. 血中碳氧血红蛋白含量测定
E. 尿中6-ALA含量测定

正确答案：D。血中碳氧血红蛋白含量测定

解析：本题考查一氧化碳中毒诊断依据。当怀疑一氧化碳中毒时，应根据吸入较高浓度CO的接触史和急性发生的中枢神经损害的症状和体征，结合血中碳氧血红蛋白（D对ABCE错）（HbCO）及时测定的结果，现场卫生学调查及空气中CO浓度测定资料，并排除其他病因后，即可诊断为急性一氧化碳中毒。